蜘蛛痣罕见于下列哪个部位
A. 面颊部
B. 手背
C. 前胸
D. 上臂
E. 下肢

正确答案：E。下肢

解析：蜘蛛痣是指皮肤小动脉末端分支性扩张所形成的血管痣，形似蜘蛛，多出现于上腔静脉分布的区域，如面部（A对）、颈部、手背（B对）、上臂（D对）、前胸（C对）和肩部等处，大小不等。下肢（E错，为本题正确答案）为下腔静脉分布区域，故蜘蛛痣罕见。